适合餐前服用的是
A. 泼尼松龙
B. 奥利司他
C. 氟伐他汀
D. 多潘立酮
E. 吲哚美辛

正确答案：D。多潘立酮

解析：本题考查药品服用的适宜时间。多潘立酮（D对）是促胃动力药，餐前服用有助消化。泼尼松龙（A错）是糖皮质激素类药物，清晨服用。奥利司他（B错）是减肥药，进餐时服用。氟伐他汀（C错）宜于睡前服用。吲哚美辛（E错）宜在餐后服用。